女，24岁，经产妇。阴道分娩后72小时，自觉乳房胀痛，发热。T37.5℃，下腹部阵发性疼痛伴阴道少许流血。正确的处理是
A. 应用抗生素
B. 口服镇痛剂
C. 局部理疗
D. 排空乳房
E. 静脉滴注缩宫素

正确答案：D。排空乳房

解析：女，24岁，经产妇。阴道分娩后72小时（处于产褥期），自觉乳房胀痛，发热。T37.5℃（正常体温36～37℃），下腹部阵发性疼痛伴阴道少许流血。据病史和临床表现，考虑患者为泌乳热。所以正确的处理为排空乳房（D对）。应用抗生素（A错）虽正确，但不为最佳答案。口服镇痛剂（B错）、局部理疗（C错）、静脉滴注缩宫素（E错）均有利于患者恢复病情，但不作为首选答案。